对于肝硬化而言，酗酒是乙型肝炎病毒感染的
A. 必要且充分病因
B. 必要非充分病因
C. 充分非必要病因
D. 非必要非充分病因
E. 互补病因

正确答案：E。互补病因

解析：本题考查互补病因。疾病可以通过不同于所关注病因的其他充分病因实现，比如酗酒是肝硬化的病因，但是不饮酒的人同样可能患肝硬化，因为肝硬化还可以通过其他充分病因而发生，如乙型病毒性肝炎病毒感染，所以对于肝硬化而言，酗酒是乙型肝炎病毒感染的互补病因（E对ABCD错）。